全口义齿选磨时，正中（牙合）一侧上颌舌尖早期接触，侧方（牙合）没有早接触，则应选磨
A. 上颌舌尖
B. 下颌舌尖
C. 上颌颊尖
D. 下颌颊尖
E. 下颌中央窝

正确答案：E。下颌中央窝

解析：正中（牙合）早接触的选磨：正中（牙合）早接触可分为支持尖早接触和非支持尖早接触。对于上牙颊尖和下牙或下牙舌尖与上牙的早接触，应按照BULL法则，调磨非支持尖，即调磨上后牙颊尖和下后牙舌尖。对于支持尖早接触，即上牙舌尖或下牙颊尖分别与对（牙合）牙中央窝和近远中边缘嵴之间的早接触，应结合侧方（牙合）平衡侧接触情况，如果正中（牙合）有早接触的支持尖在作为平衡侧时也存在（牙合）干扰，则调磨支持尖。如果作为平衡侧时无（牙合）干扰，则调磨与支持尖相对的对（牙合）牙的中央窝或（牙合）边缘嵴。掌握“全口义齿初戴”知识点。